女，40岁。半月前头痛，恶心，呕吐2次，伴低热，问话不答。独自发呆，卧床不起，抽搐2次。査体：血压140/90mmHg，下肢肌张力增高，右侧巴氏征（+），脑电图：弥漫性δ波以额颈为主，有阵发性尖波发放。首选的治疗手段
A. 心理治疗
B. 中药治疗
C. 抗病毒治疗与对症治疗
D. 抗抑郁药物
E. 电击治疗

正确答案：C。抗病毒治疗与对症治疗

解析：该患者半月前头痛，恶心，呕吐2次，伴低热，问话不答、独自发呆（表现为言语减少，精神运动性抑制症状），査体：下肢肌张力增高，右侧巴氏征阳性，脑电图：弥漫性δ波以额颈为主，有阵发性尖波发放，故诊断为病毒性脑炎所致精神障碍。应首选抗病毒治疗（阿昔洛韦）与对症治疗（如降温、脱水）（C对）。抗病毒治疗（阿昔洛韦）能有效降低脑炎患者（如单纯疱疹病毒性脑炎）的死亡率，常用剂量为一次10mg/Kg，静脉滴注，每８小时一次，共10天，另外，积极的对症治疗（如降温、脱水）合并激素治疗和支持疗法（如补充液体、加强护理等）。